患者产后大出血，继则冷汗淋漓，面色苍白，甚则晕厥。其病机是
A. 气血两虚
B. 气血失和
C. 气不摄血
D. 气随血脱
E. 气滞血瘀

正确答案：D。气随血脱

解析：患者有产后大出血的病史，津随气泄，故冷汗淋漓；血亡气脱，气血不能上荣于面，故面色苍白；神随气散，神无所主，甚则晕厥，故其病机为气随血脱（D对）。气血两虚（A错）证指兼有气虚和血虚的证候，其证候表现为神疲乏力，少气懒言，自汗，面色淡白，头晕目眩，心悸失眠，形体消瘦，肢体麻木，月经量少色淡，甚或闭经，舌质淡白，脉细无力。气血失和（B错）证，即气虚血瘀证，指兼有气虚和血瘀的证候，其证候表现为面色淡白，倦怠乏力，少气懒言，胸胁疼痛如刺，痛处固定不移、拒按，舌淡暗或有紫斑、紫点，脉涩。气不摄血（C错）证指慢性出血与气虚的证候同见，其证候表现为鼻衄、齿衄、崩漏等各种出血，面色淡白无华，神疲乏力，少气懒言，心悸失眠，舌淡白，脉弱。气滞血瘀（E错）证指气滞和血瘀的证候兼并出现，其证候表现为局部胀闷走窜疼痛，甚或刺痛，疼痛固定、拒按；妇女可见经行不畅，经色紫暗或夹血块；舌质紫暗或有紫斑、紫点，脉弦涩。